20岁男性患者咳嗽数周。1个月前开始感到疲劳，食欲减退，发热2周后咳痰中带血丝，体重减轻。体温38℃，非急性面容，右上肺有啰音，WBC11x10⁹/L，多形核63%，临床怀疑患肺结核，取痰做下列处置，哪项是错误的
A. 做结核菌素试验
B. 痰浓缩集菌涂片进行抗酸染色
C. PCR查结核分枝杆菌核酸
D. 痰结核分枝杆菌培养
E. 痰培养物接种豚鼠进行动物实验

正确答案：A。做结核菌素试验